后纵隔内的结构，不包括
A. 主支气管
B. 半奇静脉
C. 膈神经
D. 交感干
E. 胸导管

正确答案：C。膈神经

解析：后纵膈内的结构，不包括膈神经（C错，为本题正确答案）。